患者，男，8岁，头皮有圆形覆盖灰白鳞屑的斑片，病损区毛发干枯无泽，在距头皮0.3～0.8cm处折断而参差不齐，头发易于拔落且不疼痛，病发根部包绕有白色鳞屑形成的菌鞘，应诊断为
A. 白疕
B. 白秃疮病
C. 肥疮
D. 体癣
E. 花斑癣

正确答案：B。白秃疮病

解析：白疕因其“肤如疹疥，色白而痒，搔起白皮”而得名，其特点是：在红斑上有松散的银白色鳞屑，抓之有薄膜及露水珠样出血点，患者无薄膜、露水珠样出血点等表现（A错）。白秃疮皮损特征是在头皮有圆形或不规则的覆盖灰白鳞屑的斑片，病损区毛发干枯无泽，常在距头皮0.3~0.8cm处折断而呈参差不齐（B对）。肥疮特征是：有黄癣痂堆积，癣痂呈蜡黄色，肥厚，富黏性，边缘翘起，中心微凹，上有毛发贯穿，质脆易粉碎，有特殊的鼠尿臭（C错）。体癣相当于圆癣，圆癣的皮损特征为环形或多环形、边界清楚、中心消退、外围扩张的斑块（D错）。花斑癣皮损好发于颈项、躯干，尤其是多汗部位以及四肢近心端，为大小不一、边界清楚的圆形或不规则的无炎症性斑块，色淡褐、灰褐至深褐色，或轻度色素减退，或附少许糠秕状细鳞屑，常融合成片（E错）。